经产妇，28岁。妊娠37周，阴道无痛性多量流血5小时入院。查体：血压80/60mmHg，脉搏102次/min。无宫缩，宫底在剑突下2横指，臀先露，胎心94次/min，骨盆外测量正常。本例最恰当的处理是
A. 期待疗法
B. 人工破膜
C. 外转胎位术
D. 静滴缩宫素
E. 立即剖宫产

正确答案：E。立即剖宫产